在防尘技术改革的工艺过程中，下列措施中哪一项不能根本消除粉尘危害
A. 彻底革新生产设备
B. 以无矽物质代替使用含石英材料
C. 远距离操作
D. 密闭发生场所并用风力运输
E. 全过程采用计算机控制

正确答案：C。远距离操作

解析：本题考查消除粉尘危害的措施。我们的综合防尘和降尘措施可以概括为“革、水、密、风、护、管、教、查”八字方针，具体地说：①革，改革生产工艺和革新生产设备，可以通过用低毒或无毒的物质代替有毒物质（B对），改进生产工艺，还可以通过采用计算机操控（E对），革新生产设备（A对）的方式来降尘，这是消除粉尘危害的根本途径；②水，即湿式作业，可降低环境粉尘浓度；③密，将尘源密闭；④风，加强通风及抽风除尘（D对）；⑤护，即个人防护；⑥管，经常性地维修和管理工作；⑦教，加强宣传教育；⑧查，定期检查环境空气中粉尘浓度和接触者的定期体格检查。粉尘是漂浮在空中的微粒，远距离操作（C错，为本题正确答案）并不是消除粉尘危害的有效途径。